患儿，8个月。腹泻4天，水样便，1日10余次。12小时无尿，呼吸深大，前囟、眼窝明显凹陷，四肢凉，血钠127mmol/L，血钾4mmol/L，血钙9mg/dl，二氧化碳结合力11.2mmol/L，首批应输入下述哪种混合液
A. 4：3：2液（2/3张）
B. 3：2：1液（1/2张）
C. 2：1等张含钠液
D. 1：2液（1/3）
E. 1：1液（1/2张）

正确答案：C。2：1等张含钠液

解析：患儿腹泻,无尿，呼吸深大,前囟,眼窝明显凹陷,四肢凉（提示该患者重度缺水）；血钠127mmol/L（正常值为130～150mmol/L，提示该患者为低渗性脱水），根据患儿的临床表现、症状和体征，多考虑诊断为腹泻所致的重度低渗性脱水。根据重度脱水的静脉补液的要求首批输入应为2：1等张含钠液（C对）；1/2张含钠液（BE错）用于重度等渗缺水第二阶段的补液。1/3张含钠液（D错）用于重度高渗性脱水第二阶段的补液。2/3张含钠液（A错）用于重度低渗性脱水第二阶段的补液。